下列各项，属感染因素引起的体表化脓性疾病的是
A. 疮疡
B. 疔疮
C. 疡
D. 外疡
E. 溃疡

正确答案：A。疮疡

解析：疮疡：有广义和狭义之分。广义者指一切体表外科疾病的总称；狭义者是指发于体表的化脓性疾病（A对）。疔（B错）是一种发病迅速，易于变化而危险性较大的急性化脓性疾病，多发于颜面和手足等处。疡（C错）又名外疡（D错），是一切外科疾病的总称。溃疡（E错）指一切外科疾病溃破的疮面。